肾上腺素是
A. α受体激动药
B. β受体激动药
C. α、β受体激动药
D. M受体激动药
E. N受体激动药

正确答案：C。α、β受体激动药

解析：本题考查药物的作用机制。肾上腺素是α、β受体激动药（C对）。肾上腺素激动α、β受体，主要作用部位为心脏、血管及平滑肌。α受体激动药（A错）有去甲肾上腺素、间羟胺、去氧肾上腺素等。β受体激动药（B错）有异丙肾上腺素、多巴酚丁胺等。M受体激动药（D错）有毛果芸香碱等。N受体激动药（E错）有烟碱等。